某地区的发病率显著超过历年（散发）的发病率水平指
A. 暴发
B. 流行
C. 散发
D. 大流行
E. 有季节性

正确答案：B。流行

解析：流行指某病在某地区的发病率显著超过历年（散发）的发病率水平。掌握“流行病学资料与疾病分布”知识点。